外来化合物对免疫功能影响的表现不包括
A. 免疫抑制反应
B. 免疫增强反应
C. 降低机体抵抗力
D. 自身免疫反应
E. 提高机体免疫力

正确答案：E。提高机体免疫力